患者，男性，54岁。2月前发现左肩胛骨及左上肢内侧疼痛，逐渐加重，伴有低热，2年前胸部X线检查正常。查体：左眼睑下垂，瞳孔缩小，眼球内陷。X线显示左前第二肋以上至肺尖部有高密度阴影。诊断应考虑
A. 肺门淋巴结结核
B. 急性粟粒型肺结核
C. 支原体肺炎
D. 支气管肺癌
E. 慢性纤维空洞型肺结核

正确答案：D。支气管肺癌

解析：肺尖部肿瘤可以侵袭或压迫左肩胛及左上肢导致局部的疼痛，随着肿瘤发展疼痛会逐渐加重，当颈交感神经遭到侵袭则会出现同侧上眼睑下垂、瞳孔缩小、眼球内陷、面部无汗等颈交感神经综合征表现（D对）。肺门淋巴结结核多见于儿童或青年，有结核中毒症状，结核菌素试验多呈强阳性，抗结核治疗有效。影像学检查有助于鉴别诊断（A错）。粟粒型肺结核X线表现为病灶大小相等、分布均匀的粟粒样结节，常伴有全身中毒症状，抗结核治疗有效（B错）。支气管肺炎潜伏期2～3周，通常起病较缓慢。症状主要为乏力、咽痛、头痛、咳嗽、发热、食欲不振、腹泻、肌痛、耳痛等。咳嗽多为阵发性刺激性呛咳，咳少量黏液（C错）。空洞性肺结核起病缓慢，病程较长，常伴有结核中毒症状，如长期咳嗽、午后低热、乏力、盗汗或反复咯血等。X线胸片示空洞壁较厚，一般无液平面，周围可见结核浸润病灶，或呈斑点状、条索状、结节状或肺内有其他部位的结核播散灶（E错）。